腭裂对患者的影响主要是
A. 软组织畸形
B. 骨组织畸形
C. 咬合错乱
D. 吸吮、进食和语言障碍
E. 心理障碍

正确答案：D。吸吮、进食和语言障碍

解析：本题考查腭裂对患者的影响。腭裂是口腔颌面部常见的先天性畸形，它可单独发生也可与唇裂同时伴发，由于患者腭部裂开，使口鼻相通，口腔内不能或难以产生负压，无法形成腭咽闭合，同时，腭裂患者发出的元音有过度鼻音，发出的辅音不清晰且软弱无力，影响患者与他人的交流，因此，腭裂可引起患者吸吮、进食和语言障碍（D对），这也成为腭裂对患者最主要的影响。腭裂还可造成软组织畸形（A错），部分患者可伴有不同程度的骨组织畸形（B错）、咬合错乱（C错），进而给患者造成心理障碍（E错），以上这些都是腭裂对患者的影响，但非主要影响。